某男，17岁。皮肤大片风团，色红，瘙痒剧烈，伴有脘腹疼痛，嗳气恶心，神疲纳呆，大便秘结，舌红苔薄黄，脉弦滑数。诊断为瘾疹。应采用的治法是
A. 疏风散寒止痒
B. 疏风解表，通腑泄热
C. 养血祛风，润燥止痒
D. 疏风清热止痒
E. 清热凉血，祛风止痒

正确答案：B。疏风解表，通腑泄热

解析：本题考查的是瘾疹的辨证论治。某男，17岁。皮肤大片风团，色红，瘙痒剧烈，伴有脘腹疼痛，嗳气恶心，神疲纳呆，大便秘结，舌红苔薄黄，脉弦滑数。诊断为瘾疹。应采用的治法是疏风解表，通腑泄热（B对）。瘾疹是一种皮肤出现风团，时隐时现的瘙痒性、过敏性皮肤病。其临床特点是皮肤出现风团，色红或白，形态各一，发无定处，骤起骤退，退后不留痕迹，自觉瘙痒。临床上可分为急性和慢性，急性者骤发速愈，慢性者可反复发作。西医学的荨麻疹以上述表现为主者，可参考此内容辨证论治。（一）风寒束表证：【症状】风团色白，遇寒加重，得暖则减；伴恶寒，口不渴。舌质淡红，苔薄白，脉浮紧。【治法】疏风散寒止痒（A错）。（二）风热犯表证：【症状】风团鲜红，灼热剧痒，遇热则剧，得冷则减；伴发热，恶寒，咽喉肿痛。舌质红，苔薄白或薄黄，脉浮数。【治法】疏风清热止痒（D错）。（三）胃肠湿热证：【症状】风团大片色红，瘙痒剧烈；发疹的同时伴脘腹疼痛，恶心呕吐，神疲纳呆，大便秘结或泄泻。舌质红，苔薄白或黄，脉弦滑数。【治法】疏风解表，通腑泄热。（四）血虚风燥证：【症状】反复发作，迁延日久，午后或夜间加剧；伴心烦易怒，口干，手足心热。舌红少津，脉沉细。【治法】养血祛风，润燥止痒（C错）。